妊高症患者，正常分娩胎盘自然娩出时失血不多，产后突然发生面色苍白，血压下降，脉搏细弱，其发病原因不考虑下列哪一项
A. 患者对失血的耐受性降低
B. 孕期长期限盐，引起低钠血症
C. 产后腹压突降，内脏血管扩张，回心血量减少
D. 并发子宫破裂，内出血
E. 产前有血容量偏低，未很好纠正

正确答案：D。并发子宫破裂，内出血

解析：妊高症患者，正常分娩胎盘自然娩出时失血不多，产后突然发生面色苍白（提示患者失血），血压下降（提示休克），脉搏细弱，其发病原因不考虑并发子宫破裂，内出血（D错，为本题正确答案），子宫破裂发生于妊娠晚期或分娩期，该患者是产后突发。当患者对失血的耐受降低（A对）、产后腹压突降，内脏血管扩张，回心血量减少（C对）、产前有血容量偏低，未很好纠正（E对）都会引起血压降低，从而导致休克。孕期长期限盐（B对），可导致血压降低，又有产后出血的诱因，从而导致休克。